牵正散的主治病症为
A. 类中风
B. 肝热生风
C. 风邪初中经络
D. 外感风邪头痛
E. 风中头面经络

正确答案：E。风中头面经络

解析：牵正散证系由风痰阻于头面经络所致（E对）。足阳明之脉挟口环唇，足太阳之脉起于目内眦。太阳外中于风，阳明内蓄痰浊，风痰循经阻于头面经络，则经隧不利，筋肉失养，缓而不用，加之无邪之侧，气血运行通畅，牵引筋肉之缓侧，故见口眼锅斜。治宜祛风化痰，通络止痉。镇肝息风汤主治类中风（A错）。羚角钩藤汤主治肝热生风证（B错）。大秦艽汤主治风邪初中经络证（C错）。川芎茶调散主治外感风邪头痛（D错）。